渗出的组胺的主要作用
A. 引起发热
B. 起趋化作用
C. 使血管通透性升高
D. 导致疼痛
E. 加重组织损伤

正确答案：C。使血管通透性升高

解析：炎症介质组胺在炎症灶内主要作用于血管内皮细胞的H1受体，可使血管扩张和血管通透性增高（C对）。可引起发热（A错）的炎症介质有细胞因子IL-1、TNF、前列腺素等。起趋化作用（B错）的炎症介质为趋化因子（P69），如细菌产物、C5a、LTB4等。可导致疼痛（D错）的炎症介质有前列腺素、缓激肽、P物质等。可加重组织损伤（E错）的炎症介质有白细胞溶酶体酶、NO、活性氧等。